甲型肝炎主要传播途径是
A. 飞沫
B. 血液
C. 性接触
D. 消化道
E. 母婴

正确答案：D。消化道

解析：甲型肝炎主要传播途径是粪—口途径传播，即消化道传播（D对）。传染性非典型肺炎、肺结核等主要传播途径是通过飞沫传播（A错）。艾滋病、梅毒等可通过血液（B错）、性接触（C错）、母婴（E错）传播。